质粒在细菌间的转移方式主要是
A. 转化
B. 接合
C. 转导
D. 溶原性转换
E. 原生质体融合

正确答案：B。接合

解析：接合是指细菌通过接合性质粒介导和性菌毛的中空管状结构连接沟通，将遗传物质（如F质粒、R质粒或染色体DNA片段）从供体菌转入受体菌。掌握“细菌遗传变异的物质基础及机制”知识点。